重症一氧化碳中毒患者的最有效的治疗措施是
A. 鼻导管间断低流量吸氧
B. 高压氧舱治疗
C. 吸入纯氧
D. 鼻导管持续低流量吸氧
E. 面罩吸氧

正确答案：B。高压氧舱治疗

解析：一氧化碳中毒时，高压氧舱治疗可促使碳氧血红蛋白解离，加速一氧化碳排出，高压氧治疗是一氧化碳中毒的特效疗法（B对）。鼻导管间断低流量吸氧（A错）、吸入纯氧（C错）、鼻导管持续低流量吸氧（D错）、面罩吸氧（E错）均不足以使碳氧血红蛋白解离，虽然有效果，但都不如高压氧舱治疗。